下列哪项因素不是直接引起DIC出血的原因？
A. 凝血因子大量消耗
B. 单核-巨噬细胞系统功能下降
C. 血小板大量消耗
D. 纤维蛋白降解产物的作用
E. 继发性纤溶亢进

正确答案：B。单核-巨噬细胞系统功能下降

解析：凝血因子大量消耗（A对）和血小板大量消耗（C对）使血液中纤维蛋白原、 凝血酶原、FV、FVIII、FX及血小板明显减少，使凝血过程发生障碍，导致出血。纤维蛋白降解产物的作用（D对）可直接引起DIC出血，纤溶酶水解纤维蛋白（原）产生的各种片段有明显的抗凝作用，如：X、Y、D片段可妨碍纤维蛋白单体聚合，Y、E片段有抗凝血酶作用。继发性纤溶亢进（E对）直接引起DIC出血，因为纤溶酶是活性较强的蛋白酶，除可使纤维蛋白降解外，还可水解凝血因子，如：FV、FVIII、 凝血酶、FXII等，使凝血功能发 生障碍，引起出血。单核-巨噬细胞系统功能下降（B错，为本题正确答案）是影响 DIC 发生发展的因素。